下列哪个不是儿童青少年常见心理-行为问题
A. 学业相关问题
B. 情绪问题
C. 发育问题
D. 品行问题
E. 不良习惯

正确答案：C。发育问题